表里实热证属于
A. 证候错杂
B. 证候转化
C. 证候相兼
D. 虚实真假
E. 寒热真假

正确答案：C。证候相兼

解析：证候相兼是指在疾病某一阶段，出现不相对立的两纲或两纲以上的证同时存在的情况；故表里实热证属于证候相兼（C对）。证候错杂是指疾病的某一阶段同时存在八纲中对立两纲的证（A错）。证候转化是指在疾病的发展变化过程中，八纲中相互对立的证在一定条件下可以相互转化（B错）。虚实真假分为真实假虚和真虚假实两种，真实假虚证指疾病的本质为实证，却出现某些“虚羸”的现象，即所谓“大实有羸状”；真虚假实证指疾病的本质为虚证，反出现某些“盛实”的现象，即所谓“至虚有盛候”（D错）。寒热真假分为真热假寒证和真寒假热证两种，真热假寒证是指疾病的本质为热证，却出现某些“寒象”，又称“热极似寒”；真寒假热证是指疾病的本质为寒证，却出现某些“热象”，又称“寒极似热”（E错）。